男性，52岁。反复无痛性肉眼血尿伴条状血块2月，|膀胱镜见右输尿管口喷血，尿细胞学可见癌细跑。明确诊断后首选的治疗方法是
A. 右肾切除术
B. 右肾、输尿管切除
C. 化疗
D. 放疗
E. 免疫治疗

正确答案：B。右肾、输尿管切除

解析：中年男性患者，无痛性肉眼血尿伴条状血块，膀胱镜见右输尿管口喷血（提示可能有上尿路肿瘤），尿细胞学可见癌细胞，结合患者病史、临床表现和相关检查，应考虑为右侧肾盂、输尿管癌。明确诊断后，首选的治疗为切除患肾及全长输尿管（B对），包括输尿管开口部位的膀胱壁。单纯肾切除术（A错）主要用于肾结核的治疗。肾盂癌对全身化疗（C错）不敏感。放疗（D错）仅用于晚期浸润性肿瘤。免疫治疗（E错）主要用于肾癌。